医生的责任感具有
A. 稳定性
B. 冲动性
C. 强制性
D. 灵活性
E. 全民性

正确答案：A。稳定性

解析：医德情感包括同情感、责任感和事业感。同情感是促使医务人员为患者服务的原始动力，它是医德情感内容中低层次的情感，是责任感的基础，责任感是同情感的升华，这是一种自觉的道德意识且使医务人员的行为具有稳定性（A对），医德情感内容中高层次的情感是事业感。